医药门市部凭盖有医疗单位公章的医生处方零售的药品是
A. 精神药品
B. 一类精神药品
C. 二类精神药品
D. 麻醉药品
E. 戒毒药品

正确答案：C。二类精神药品

解析：本题考查麻醉药品和精神药品零售规定。医药门市部凭盖有医疗单位公章的医生处方零售的药品是第二类精神药品（C对）。零售第二类精神药品时，处方应经执业药师或其他依法经过资格认定的药学技术人员复核；第二类精神药品一般每张处方不得超过7日常用量，禁止超剂量或者无处方销售第二类精神药品。麻醉药品（D错）和第一类精神药品（B错）不得零售。除经批准的药品零售连锁企业外，其他药品零售企业不得从事第二类精神药品零售活动。